下列关于上颌前牙近远中向的倾斜度的描述中，不正确的是
A. 上颌中切牙较正或稍向近中倾斜
B. 上颌侧切牙向近中倾斜角度较中切牙和尖牙者大
C. 上颌尖牙倾斜角度较中切牙者稍大
D. 上颌尖牙略向近中倾斜
E. 上颌尖牙倾斜角度较侧切牙稍大

正确答案：E。上颌尖牙倾斜角度较侧切牙稍大

解析：上颌中切牙较正或稍向近中倾斜，上颌侧切牙向近中倾斜角度较中切牙和尖牙者大，上颌尖牙略向近中倾斜（倾斜角度较中切牙者稍大，但略小于侧切牙）。掌握“牙列”知识点。